暂时性牙关紧闭是由于麻药注入
A. 翼内肌或翼外肌
B. 翼内肌或咬肌
C. 翼外肌或咬肌
D. 翼内肌或颞肌
E. 翼外肌或颊肌

正确答案：B。翼内肌或咬肌

解析：本题考查暂时性牙关紧闭。暂时性牙关紧闭是局麻的并发症，可发生于下牙槽神经阻滞麻醉口内注射法后，由于麻药注入翼内肌或咬肌（B对）内，使肌暂时失去收缩与舒张的功能，并停滞于收缩状态，因而出现的牙关紧闭，除感染所致的牙关紧闭外，一般都是暂时性的，大多在2～3h内自行恢复。翼内肌及咬肌共同支配下颌的上提运动，仅麻醉其中之一时，另一个仍能支配下颌上提，不会造成暂时性牙关紧闭（ACDE错）。